男性，20岁，前牙有暗黄色斑点。病变牙的磨片显示，釉柱间质矿化不良，而釉质表层过度矿化。最可能的诊断是
A. 釉质发育不全
B. 氟牙症
C. 遗传性乳光牙本质
D. 四环素牙
E. 畸形中央尖

正确答案：B。氟牙症

解析：本题考查牙发育异常。男性，20岁，前牙有暗黄色斑点（符合氟牙症的临床表现），病变牙的磨片显示，釉柱间质矿化不良，而釉质表层过度矿化（符合氟牙症的病理变化），故考虑为氟牙症（B对）。氟牙症患牙的临床表现可有很大不同，病变轻者牙釉质上出现无光泽的白色斑点斑块或条纹；中等程度者病变区呈黄色、棕色、黑色，可伴有程度不同的牙釉质形成障碍，牙面上出现不规则凹陷；在严重病例,窝状凹陷相互融合牙正常形态丧失。镜下可见牙釉质矿化不良，尤其是在釉柱之间及有机物较多的薄弱处。但牙釉质表层过度矿化，釉柱方向不规则，釉牙本质界的弧形结构较正常牙更加明显。氟牙症镜下可见牙釉质矿化不良尤其是在釉柱之间及有机物较多的薄弱处，但牙釉质表层过度矿化。表层钙化良好，其深方的表层下区存在弥漫性的矿化不良。釉质发育不全（A错）属于牙釉质发育异常，由于牙釉质基质形成时的障碍造成，可发生在单个牙或者一组牙，白垩色斑的周界比较明确，纹线与牙釉质的生长发育线相平行吻合，分为轻度和重度，轻度牙釉质发育不全的牙釉质形态基本完整，色泽和透明度方面有所改变，形成白垩斑的釉质，与题目中的临床病理表现不吻合。遗传性乳光牙本质（C错）是一种遗传疾病，主要发生在牙本质上，最主要的症状是牙冠部位开始出现半透明的乳光色或者是浅黄色，也可伴有牙釉质的磨损。镜下可见牙本质小管排列紊乱，管腔增大，单位牙本质中牙本质小管数量减少。与题目中的临床病理表现不吻合。四环素牙（D错）是由于服用四环素族药物引起的牙齿着色疾病，患者出现永久性牙齿变黄、灰或灰黑色，初始呈黄色，在阳光照射下会有明亮黄色荧光，而后逐渐由黄色变成棕褐色或深灰色，与题目中的临床病理表现不吻合。畸形中央尖（E错）是牙体发育畸形的一种，多见于下颌第二前磨牙，偶见于上颌前磨牙，在牙合面颊舌尖中间突起一圆锥状的额外尖，与题目中的临床病理表现不吻合。